下列关于血尿素氮的改变及临床意义的叙述正确的是
A. 上消化道出血时，血尿素氮减少
B. 大面积烧伤时，血尿素氮减少
C. 严重的肾盂肾炎，血尿素氮减少
D. 血尿素氮对早期肾功能损害的敏感性差
E. 血尿素氮对早期肾功能损害的敏感性强

正确答案：D。血尿素氮对早期肾功能损害的敏感性差

解析：血尿素氮（BUN）是蛋白质代谢的终末产物，上消化道出血（A错）、大面积烧伤（B错）时可导致蛋白质分解增多，从而使血尿素氮增加。严重的肾盂肾炎（C错）属于器质性肾功能损害，可出现血尿素氮增加。由于血尿素氮只有当GFR下降至50%以下时才会升高，故血尿素氮对早期肾功能损害的敏感性差（D对E错）。